患者，女性，20岁。因左侧后牙遇甜食物不适就诊。检查：左下6（牙合）面龋洞，中等深，探软、稍敏感，冷刺激进洞后稍敏感，冷热试验与对照牙相同。该患牙诊断可能为
A. 浅龋
B. 中龋
C. 深龋
D. 牙髓充血
E. 慢性牙髓炎

正确答案：B。中龋

解析：本题考查中龋。患者，女性，20岁。因左侧后牙遇甜食物不适就诊。检查：左下6（牙合）面龋洞，中等深，探软、稍敏感，冷刺激进洞后稍敏感，冷热试验与对照牙相同。该患牙诊断可能为中龋（B对）。中龋病变进展到牙本质，探诊龋洞稍敏感，温度刺激进入龋洞后可稍感敏感，温度测验同正常对照牙。浅龋位于釉质内，患牙一般无主观症状，遭受外界的物理和化学刺激如冷、热、酸、甜刺激时亦无明显反应（A错）。深龋时食物入洞疼痛，遇冷热和化学刺激产生的疼痛更剧烈（C错）。牙髓充血表现为冷刺激一过性敏感（D错）。慢性牙髓炎有时可有不明显的阵发性隐痛或每日出现定时钝痛，患者可有很长时间的冷热刺激痛史，探诊患牙较迟钝，对温度刺激的反应可为敏感，也可为迟热侧引起的迟缓性疼痛，多有叩诊不适（E错）。